患者吐血色红，夹有食物残渣，脘腹胀闷，口臭，便秘，大便色黑，舌红，苔黄，脉滑数，治疗宜选用
A. 泻心汤合清胃散
B. 泻心汤合十灰散
C. 玉女煎合左金丸
D. 龙胆泻肝汤合清胃散
E. 清胃散合茜根散

正确答案：B。泻心汤合十灰散

解析：患者以吐血为主诉。胃中积热，胃失和降，气血不和，故脘腹胀闷，甚则作痛。热伤胃络，故吐血色红。胃为水谷之海，胃主纳谷，其性主降，胃气上逆，故呕血夹食物残渣。胃热耗津，故大便秘结。血随糟粕而下，则使大便色黑。舌红，苔黄腻，脉滑数，为内有积热之象，故诊断患者为吐血之胃中积热证，治以清胃泄热，凉血止血，可用泻心汤合十灰散治疗（B对）。